急性根尖周炎应急处理正确的是
A. 在局麻下进行
B. 开通髓腔，引流根管
C. 穿通根尖孔
D. 有脓肿时切开排脓
E. 以上均是

正确答案：E。以上均是

解析：本题考查急性根尖周炎的应急处理。急性根尖周炎应急处理的目的是引流炎症渗出物和缓解因之而形成的髓腔高压，以减轻剧痛。该病疼痛剧烈因此需在局麻下（A对）开通髓腔，引流根管（B对），穿通根尖孔（C对），建立引流通道，使根尖处的脓液得以顺根管从缺损的牙冠排出。急性炎症4～5天后有脓肿形成时，应在局麻或表面麻醉下切开排脓（D对），达到引流脓液的目的，防止炎症扩散。（ABCD均对，故E为本题的正确答案）。